患者，女，59岁，绝经后3年，近日出现腰背疼痛，负重时疼痛加剧，骨密度T值为3.5，诊断为骨质疏松，每天补充维生素D800IU，元素钙500mg，同时给予唑来膦酸治疗。唑来膦酸正确的给药方案是
A. 5mg静脉滴注，每周一次
B. 5mg静脉滴注，每年一次
C. 4mg静脉滴注，每日一次
D. 10mg口服，每日一次
E. 70mg口服，每周一次

正确答案：B。5mg静脉滴注，每年一次

解析：本题考查唑来膦酸给药方案。唑来膦酸用于治疗骨质疏松症的用法用量为4mg iv或5mg iv，给药时间＞15xin；用于治疗每年1次（B对），预防每2年1次。